女，52岁。进行性体重增加伴头晕、腰痛2年。查体：BP180/120mmHg，多毛，面圆，有痤疮。实验室检查：尿糖血浆皮质醇：早8时810nmol/L（正常55～248nmol/L），下午4时752nmol/L（正常55～138nmol/L），初步诊断应进行的检查是
A. 大剂量地塞米松抑制试验
B. ACTH兴奋试验
C. 螺内酯抑制试验
D. 酚妥拉明抑制试验
E. 小剂量地塞米松抑制试验

正确答案：E。小剂量地塞米松抑制试验

解析：中年女性患者，进行性体重增加伴头晕、腰痛2年，查体：BP180/120mmHg（正常值为90～140/60～90mmHg，血压增高），多毛，面圆，有痤疮（库欣综合征的典型临床表现），实验室检查：尿糖血浆皮质醇：早8时810nmol/L（正常55～248nmol/L），下午4时752nmol/L（正常55～138nmol/L）（提示皮质醇增多并失去昼夜的规律），根据患者的临床表现、体征及实验室检查，最可能的诊断为库欣综合征，为进一步证实该诊断应首先进行的检查是小剂量地塞米松抑制试验（E对）。